与四肢强健与否关系密切的是
A. 肝的功能
B. 心的功能
C. 脾的功能
D. 肺的功能
E. 肾的功能

正确答案：C。脾的功能

解析：人体的四肢需要脾胃运化的水谷精微及津液的营养和滋润，脾气健运则四肢的活动充足，强健有力，所以脾气的运化功能与肌肉的壮实及其功能的发挥之间有着密切的联系（C对）。肝在体合筋（A错）。心在体合脉（B错）。肺在体合皮（D错）。肾在体合骨（E错）。